一般说来水质最软的水源是
A. 江河
B. 泉水
C. 雨雪水
D. 井水
E. 湖水

正确答案：C。雨雪水

解析：本题考查水质最软的水源。水质最软的水源是指水中含有的矿物质含量最低的水源，雨雪水（C对ABDE错）是从天空落下的，没有经过任何地表污染，所以其矿物质含量最低，是最软的水源。